患儿，男，4岁6个月。患急性支气管炎，症见咳嗽不爽，痰稠难咯，口渴咽痛，鼻塞流涕，汗出恶风，舌红苔薄黄，脉浮数。首选方剂是
A. 杏苏饮
B. 桑菊饮
C. 沙参麦冬汤
D. 荆防败毒散
E. 二陈汤

正确答案：B。桑菊饮

解析：该患儿已被明确诊断为急性支气管炎。急性支气管炎是支气管黏膜的急性炎症，常累及气管，临床以咳嗽、咯痰为主要症状。根据“口渴咽痛，鼻塞流涕，汗出恶风，舌红苔薄黄，脉浮数”，可辨证为风热犯肺证--风热犯肺，肺失清肃，气道不宣，故咳嗽不爽，鼻塞流涕；风热之邪灼津炼液成痰，故痰稠难咯；咽为肺之通道，肺热伤津，故口渴咽痛；肺主皮毛，风热之邪，客肺，皮毛疏泄，故汗出恶风；舌红苔薄黄，脉浮数，为风热之邪在肺卫之象。故当治以疏风宣肺，清热止咳，宜选疏风清热，宣肺止咳的桑菊饮（B对）。杏苏散（A错）功用为清宣凉燥，理肺化痰，主治外感凉燥证。沙参麦冬汤（C错）功用为清养肺胃，生津润燥，主治内伤咳嗽之阴虚咳嗽。荆防败毒饮（D错）功用为发汗解表，消疮止痛，适用于疮肿初起。二陈汤（E错）功用为燥湿化痰，理气和中，主治湿痰证。